只有一种核酸类型的微生物是
A. 真菌
B. 病毒
C. 支原体
D. 衣原体
E. 放线菌

正确答案：B。病毒

解析：非细胞型微生物仅含有一种核酸RNA或DNA，或仅为传染性蛋白粒子，具有超级寄生性，仅在活的易感细胞中才能复制，且易变异的最低等生物体，包括病毒。掌握“微生物定义、分类及特点”知识点。